感染过程中首先出现，常为近期感染标志的抗体是
A. 1gA
B. 1gD
C. 1gE
D. 1gG
E. 1gM

正确答案：E。1gM

解析：在感染过程中IgM首先出现，但持续时间不长，是近期感染的标志（E对）。IgG随后出现，并持续较长时期（D错）。IgA主要是呼吸道和消化道黏膜上的局部抗体（A错）。IgE则主要作用于人侵的原虫和蠕虫（C错）。检测机体IgD的含量可了解机体的体液免疫功能状态，帮助诊断免疫增生、免疫缺陷、感染及自身免疫性等多种疾病，具有重要的临床意义（B错）。